DNA复性是指
A. 不同的核酸链经变性处理，它们之间形成局部的双链
B. 标记一个已知序列核酸，通过杂交反应确定待测核酸是否含有相同的序列
C. 运输氨基酸
D. 单股DNA恢复成双股DNA
E. 50％双链DNA变性时的温度

正确答案：D。单股DNA恢复成双股DNA

解析：在适宜条件下，如温度或pH值逐渐恢复到生理范围，分离的DNA双链可以自动退火（annealing），再次互补结合形成双螺旋，这个过程称为复性。掌握“DNA”知识点。